若用图形表示儿童的身高和年龄间关系，宜绘制
A. 圆图
B. 线图
C. 条图
D. 直方图
E. 散点图

正确答案：E。散点图

解析：本题考查统计图。散点图是利用平面坐标显示两个定量变量之间的关系。若表示儿童的身高和年龄间关系，宜绘制散点图（E对ABCD错）。